卫生法的分类不包括
A. 公共卫生法
B. 医疗法
C. 药事法
D. 中医药法
E. 婚姻法

正确答案：E。婚姻法

解析：按照卫生关系的不同主题、客体和权利义务内容，将调整卫生关系的发露规范进行分类，大致可划分为几个部分：公共卫生法、医疗法、药事法、中医药法和医疗保障法。它们共同构成卫生法体系。掌握“卫生法的概念、分类和作用”知识点。